患儿，三岁半，因牙齿变黑前来就诊。查：乳前牙唇面，邻面龋损，呈环形围绕牙冠，卷脱状，分布在乳前牙的冠中1/3至颈1/3处。龋腐湿软，色呈黑褐色。龋损牙齿温度活力测试同正常牙。患儿较安静，不愿与人沟通。牙龈软组织，口腔颌面部无异常。据此，针对于主诉及检查，该病在临床上所进行最有针对性的诊断是
A. 恒牙龋
B. 猛性龋
C. 猖獗龋
D. 环状龋
E. 放射性龋

正确答案：D。环状龋

解析：低龄儿童龋中国的特殊类型是喂养龋，而喂养龋在临床上常表现为环状龋，即乳前牙唇面、邻面龋较快发展成围绕牙冠的广泛性的环形龋。呈卷脱状，多见于冠中1/3至颈1/3处。有时切缘残留少许正常的釉质、牙本质，但是牙髓活力正常。掌握“乳牙龋”知识点。